吲哚美辛的临床应用是
A. 剧烈疼痛
B. 帕金森病
C. 癫痫小发作
D. 精神分裂症
E. 风湿性关节炎

正确答案：E。风湿性关节炎

解析：本题考查吲哚美辛。吲哚美辛为强效非选择性COX环氧酶抑制剂，临床可用于急慢性风湿性关节炎（E对）；剧烈疼痛（A错）临床用药一般为强效镇痛药，如吗啡；抗帕金森病（B错）用药种类多样，包括多巴胺前体药；多巴胺脱羧酶AADC抑制剂；单胺氧化酶MAO-B抑制剂；多巴胺受体激动剂；促多巴胺释放药等；癫痫小发作（C错）首选乙琥胺；精神分裂症（D错）可用抗精神分裂药物，如氯丙嗪。